氯化消毒饮用水时，杀灭水中细菌以及氧化水中有机物和还原性无机物所消耗的氯量为
A. 加氯量
B. 游离性余氯量
C. 化合性余氯量
D. 有效氯
E. 需氯量

正确答案：E。需氯量

解析：本题考查需氯量。氯化消毒饮用水时，杀灭水中细菌以及氧化水中有机物和还原性无机物所消耗的氯量为需氯量（E对ABCD错）。